承担预防接种工作的机构是
A. 经国务院卫生主管部门指定的医疗卫生机构
B. 经省级人民政府卫生主管部门指定的医疗卫生机构
C. 经县级人民政府卫生主管部门指定的医疗卫生机构
D. 经县级人民政府卫生主管部门指定的卫生防疫机构
E. 经省级人民政府卫生主管部门指定的卫生防疫机构

正确答案：C。经县级人民政府卫生主管部门指定的医疗卫生机构